法律体系按照法律效力等级由高到低包括：法律、行政法规、部门规章、规范性文件等。下列依次为法律、行政法规，部门规章的是
A. 《药品管理法》《中药品种保护条例》《疫苗储存和运输管理规范》
B. 《中医药法》《反兴奋剂条例》《医疗机构处方审核规范》
C. 《禁毒法》《化妆品监督管理条例》《医疗用毒性药品管理办法》
D. 《疫苗管理法》《放射性药品管理办法》《药品生产质量管理规范》

正确答案：D。《疫苗管理法》《放射性药品管理办法》《药品生产质量管理规范》

解析：本题考查的是药品管理法律体系。法律体系按照法律效力等级由高到低包括：法律、行政法规、部门规章、规范性文件等。下列依次为法律、行政法规，部门规章的是《疫苗管理法》《放射性药品管理办法》《药品生产质量管理规范》（D对）。1.法律：与药品监督管理职责密切相关的法律主要有4部，包括《药品管理法》《中华人民共和国疫苗管理法》（以下简称《疫苗管理法》）《基本医疗卫生与健康促进法》《中华人民共和国禁毒法》；与药品管理有关的法律有《中华人民共和国刑法》《中华人民共和国广告法》《中华人民共和国价格法》《中华人民共和国消费者权益保护法》《中华人民共和国反不正当竞争法》《中华人民共和国专利法》等（B错）。2.行政法规：国务院制定、发布的药品管理行政法规主要有10部，包括《药品管理法实施条例》《中药品种保护条例》《戒毒条例》《易制毒化学品管理条例》《麻醉药品和精神药品管理条例》《反兴奋剂条例》《血液制品管理条例》《医疗用毒性药品管理办法》（C错）《放射性药品管理办法》《野生药材资源保护管理条例》等（A错）。3.部门规章：药品管理现行有效的主要规章有20多部，包括《药品注册管理办法》《药物非临床研究质量管理规范》《药物临床试验质量管理规范》《药品生产监督管理办法》《药品生产质量管理规范》《医疗机构制剂配制质量管理规范（试行）》《医疗机构制剂配制监督管理办法（试行）》《医疗机构制剂注册管理办法（试行）》《药品经营监督管理办法》《药品经营质量管理规范》《中药材生产质量管理规范》《生物制品批签发管理办法》《处方药与非处方药分类管理办法》《药品进口管理办法》《直接接触药品的包装材料和容器管理办法》《药品说明书和标签管理规定》《药品不良反应报告和监测管理办法》《互联网药品信息服务管理办法》《药品召回管理办法》《食品药品行政处罚程序规定》《药品医疗器械飞行检查办法》等。